下列引起慢性腹泻的是
A. 食物中毒
B. 萎缩性胃炎
C. 伤寒
D. 食物过敏
E. 霍乱

正确答案：B。萎缩性胃炎